炸油条时因高温、加碱，哪种营养素损失最严重
A. 核黄素
B. 尼克酸
C. 硫胺素
D. 蛋白质
E. 无机盐

正确答案：C。硫胺素